对附着龈宽度描述正确的是
A. 龈缘至膜龈联合的距离
B. 龈沟底至膜龈联合的距离
C. 龈缘至龈沟底的距离
D. 龈沟底至釉牙骨质界的距离
E. 保障牙周健康的附着龈宽度至少3mm

正确答案：B。龈沟底至膜龈联合的距离

解析：本题考查附着龈宽度。对附着龈宽度描述正确的是龈沟底至膜龈联合的距离（B对）。附着龈的根方为牙槽黏膜，两者之间有明显的界限，称膜龈联合。膜龈联合的位置在人的一生中基本是恒定的。附着龈的宽度是指从膜龈联合至正常龈沟底的距离。